正常的血清总胆红素含量为
A. 0～6.8μmol/L
B. 0.7～1.7μmol/L
C. 1.7～10.26μmol/L
D. 3.4～17.1μmol/L
E. 1.7～21.7μmol/L

正确答案：D。3.4～17.1μmol/L

解析：正常血清总胆红素含量为3.4～17.1μmol/L（D对）。总胆红素在17.1～34.2μmol/L之间，临床无肉眼性黄疸，称为隐性黄疸。总胆红素超过34.2μmol/L，可导致皮肤、黏膜、巩膜黄染，称之为黄疸。